DIC的临床表现不包括
A. 出血
B. 微血管拴塞
C. 休克
D. 循环障碍
E. 血糖升高

正确答案：E。血糖升高

解析：本题考查弥散性血管内凝血（DIC）。DIC的临床表现不包括血糖升高（E错，为本题正确答案）。DIC除去原发疾病的临床表现外，主要临床表现包括：自发性持续多部位出血（A对）；微血管拴塞（B对）；休克（C对）或者微循环障碍（D对）；微血管病性溶血。